患者，男，52岁。患喘证日久，呼多吸少，形痩神疲，咽干口燥，喘则面红足冷，舌红脉细。治疗最宜用
A. 六味地黄丸
B. 左归丸
C. 金匮肾气丸
D. 七味都气丸合生脉散
E. 以上都不是

正确答案：D。七味都气丸合生脉散

解析：肺主呼气，肾主纳气，久病肺虚及肾，肾失摄纳故见短气息促，动则为甚，呼多吸少；腰为肾之府，肾虚则腰酸腿软；肾虚肌肤失于充养，故见形瘦神疲；咽干口燥，舌红，脉象细均为肾气阴两虚的表现；七味都气丸滋补肾阴、收敛平喘，生脉散补气养阴收敛，故治疗最宜用七味都气丸合生脉散（D对）。六味地黄丸（A错）可以滋阴养肾，用于治疗肾阴亏虚证。左归丸（B错）可以滋阴益肾，填精益髓，治疗真阴不足证。金匮肾气丸（C错）可以补肾助阳，用于治疗肾阳不足证。